阵发性睡眠性血红蛋白尿特异性的诊断依据为
A. 红细胞寿命缩短
B. Coombs试验（+）
C. 尿含铁血黄素试验（+）
D. Ham试验（+）
E. 网织红细胞增高

正确答案：D。Ham试验（+）

解析：阵发性睡眠性血红蛋白尿（PNH）是一种后天获得性造血干细胞基因突变所致的红细胞膜缺陷性慢性血管内溶血病。由于患者红细胞对补体敏感性增高，在酸化的血清中（PH6.6～6.8），经37℃孵育，易溶血，表现为Ham试验（酸溶血试验）（+）（D对），该试验是阵发性睡眠性血红蛋白尿特异性的诊断依据。红细胞寿命缩短（A错）可见于包括阵发性睡眠性血红蛋白尿在内的所有溶血性贫血，不具有特异性。Coombs试验（+）（B错）（抗人球蛋白试验）主要用于诊断自身免疫性溶血性贫血，而与阵发性睡眠性血红蛋白尿无关。含铁血黄素尿试验（+）（C错）提示慢性血管内溶血，常见于阵发性睡眠性血红蛋白尿，但在溶血初期可表现为阴性。网织红细胞是尚未完全成熟的红细胞，在周围血液中的数值可反映骨髓红细胞的生成功能。网织红细胞增高（E错）提示骨髓红细胞增生旺盛，见于各种增生性贫血。阵发性睡眠性血红蛋白尿时，网织红细胞可增高，但不是其特异性指标。